使用食品添加剂必须经过规定的食品毒理学安全评价程序，证明在使用期限内长期使用。未经卫健委允许，婴儿及儿童食品
A. 不得超过允许限量
B. 作为伪造手段
C. 对人体安全无害
D. 不得加入食品添加剂
E. 不应有破坏作用

正确答案：D。不得加入食品添加剂